修复体损坏时存在咬合创伤时，容易出现折断是由于
A. 外伤
B. 制作因素
C. 材料因素
D. 磨耗过多
E. （牙合）力过大

正确答案：E。（牙合）力过大

解析：（牙合）力过大，在深覆（牙合）、咬合紧，存在咬合创伤时，容易出现折断。掌握“修复体戴入后的问题及处理”知识点。